患者，男，40岁。确诊高血压病3年，无自觉症状。检查：血压160/95mmHg（21.3/12.6kPa），尿常规无异常，心电图及X线显示左心室肥大。应首先考虑的是
A. 高血压病一期
B. 高血压病二期
C. 高血压病三期
D. 急进型高血压
E. 高血压脑病

正确答案：B。高血压病二期

解析：患者中年男性，确诊有高血压病，检查：血压160/95mmHg（正常值90～139/60～89mmHg），尿常规无异常，心电图及X线显示左心室肥大（高血压导致的心肌代偿性肥大），根据高血压的分级标准，患者应首先考虑的是高血压病二期（B对AC错）。急进型高血压（D错）也称恶性高血压（P267），是指少数患者病情急骤发展，舒张压持续≥130mmHg，并有头痛，视力模糊，眼底出血、渗出和视盘水肿，肾脏损害突出，持续蛋白尿、血尿与管型尿。高血压脑病（E错）常有剧烈头痛，喷射性呕吐、烦躁不安、兴奋、癫痫发作、阵发性呼吸困难、疼痛等症状。